水杨酸中毒
A. SB升高
B. AB升高
C. 两者均升高
D. 两者均不升高
E. 无

正确答案：D。两者均不升高

解析：水杨酸中毒导致HC03-因缓冲过多的酸性物质而减少，由于AB、SB均受代谢因素影响，所以AB、SB值均降低（AB错，故D为本题正确答案）。